先天禀赋不足引起的紫癜，其病机是
A. 热盛迫血
B. 气不摄血
C. 阴虚火旺
D. 邪毒内结
E. 寒凝血瘀

正确答案：B。气不摄血

解析：先天禀赋不足，后天调养失宜，肾气不足，累及精髓，脾气虚衰，气血匮乏等导致气不摄血，溢于脉外，发为紫癜（B对）。热毒之邪内伤脏腑，气血阴阳失调，伤及脉络，导致血不循经，溢于脉外，病机属于热盛破血（A错）。久病或热毒之后耗伤阴液，或忧思劳倦，暗耗心血，阴液耗损等的病机为阴虚火旺（C错）。邪毒内结多见于瘰疬，噎膈等（D错）。寒凝血瘀多见于胸痹、腰痛、头痛等（E错）。